百白破疫苗的初种年龄是
A. 2个月
B. 3个月
C. 出生时
D. 8个月
E. 1岁

正确答案：B。3个月

解析：百白破疫苗的初种年龄是出生后3个月（B对）。